突发公共卫生事件的分期为
A. 潜伏期、暴发期、处理期、恢复期
B. 潜伏期、暴发期、治疗期、预防期
C. 潜伏期、发病期、处理期、恢复期
D. 潜伏期、发病期、治疗期、恢复期
E. 潜伏期、暴发期、处理期、预防期

正确答案：A。潜伏期、暴发期、处理期、恢复期